生活技能教育的理论依据包括以下几个环节：①改变知识、态度、价值观。②预防不良行为。③提高生活技能（心理社会能力）。④建立健康行为。⑤行为改变或强化。对于生活技能教育促进健康的理论环节的顺序为
A. ①⑤③④②
B. ①③⑤④②
C. ①④⑤③②
D. ①②③④⑤
E. ③①④⑤②

正确答案：B。①③⑤④②